男，70岁。劳累后突发畏寒，高热伴右侧腰痛1天。无尿频、尿急、尿痛。查体：右肾区叩击痛（+）。尿沉渣镜检WBC30～40/HP，RBC5～8/HP。为明确诊断，下列应首选的检查是
A. 血培养
B. 静脉肾盂造影
C. 尿找肿瘤细胞
D. 清洁中段尿培养+药敏
E. 肾脏B超

正确答案：D。清洁中段尿培养+药敏

解析：患者老年男性（泌尿系统感染的易感人群），劳累后突发畏寒（诱因），高热伴右侧腰痛1天。查体：右肾区叩击痛（+）。尿沉渣镜检WBC30～40/HP（＞5HP，提示为尿路感染），RBC5～8/HP（＞3HP，提示为镜下血尿）。结合患者临床表现及实验室检查，最可能的诊断是肾盂肾炎。尿细菌培养对诊断尿路感染有重要价值，并可指导治疗，为首选检查，临床可采用清洁中段尿、导尿及膀胱穿刺尿来收集尿液（D对）。静脉肾盂造影（B错）不宜在尿路感染急性期做。尿找肿瘤细胞（C错）用于膀胱肿瘤初步筛选或术后随访检查阳性提示泌尿道任何部位存在尿路上皮肿瘤可能。肾脏B超（E错）临床用于确定肾肿块性质、结石和肾积水；测定残余尿、测量前列腺体积等。